半夏、天南星均具有的功效是
A. 祛风止痉
B. 消痞散结
C. 降逆止呕
D. 燥湿化痰
E. 利气通络

正确答案：D。燥湿化痰

解析：该题考查的是半夏和天南星的功效，属记忆内容。半夏的功效 燥湿化痰，降逆止呕，消痞散结；外用消肿止痛；天南星功效 燥湿化痰，祛风解痉；外用散结消肿（D对）。